血友病的致病因素是
A. 生物性因素
B. 免疫性因素
C. 先天性因索
D. 营养性因素
E. 遗传性因素

正确答案：E。遗传性因素

解析：甲型血友病是由于位于X染色体上的凝血因子调基因发生缺失、插入或点突变，导致凝血因子VIII活性缺失、凝血障碍、出血倾向，所以血友病的致病因素是遗传性因素（E对）。